女，35岁。误服有机磷农药50ml，立即被其家人送往医院，该病人抢救成功的关键是
A. 彻底洗胃
B. 早期应用阿托品
C. 早期应用解磷定
D. 解磷定与阿托品合用
E. 静脉注射毛花苷丙

正确答案：A。彻底洗胃